人参总皂苷中具有溶血作用的皂苷苷元属于
A. 20（S）-原人参二醇
B. 20（S）-原人参三醇
C. 齐墩果酸
D. 20（S）-人参二醇
E. 20（S）-人参三醇

正确答案：B、C、E。20（S）-原人参三醇；齐墩果酸；20（S）-人参三醇

解析：本题考查的是皂苷的溶血性。人参总皂苷中具有溶血作用的皂苷苷元属于20（S）-原人参三醇（B对）、齐墩果酸（C对）与20（S）-人参三醇（E对）。皂苷的溶血性：皂苷的水溶液大多能破坏红细胞，产生溶血现象。因此在制备中药注射剂时必须对其溶血性进行考察，但口服无溶血作用，可能与其在胃肠道不被吸收或被破坏有关。各类皂苷的溶血强度是不同的，可用溶血指数来表示，溶血指数是在一定条件下能使血液中红细胞完全溶解的最低溶血浓度，例如甘草皂苷的溶血指数为1：4000。从一药材浸液及其提纯皂苷溶液的溶血指数，可以推算出样品中所含皂苷的粗略含量。皂苷之所以能溶血是因为多数皂苷能与红细胞壁上的胆固醇结合形成不溶于水的复合物，破坏红细胞的渗透性，导致胞内渗透压增加而崩解。但并不是所有的皂苷都有溶血现象，这种现象与分子结构有密切关系，例如人参总皂苷没有溶血现象，但是经过分离后的以人参三醇及齐墩果酸为苷元的人参皂苷却有显著的溶血作用，而以人参二醇（AD错）为苷元的人参皂苷则有抗溶血作用。皂苷的溶血活性还和糖部分有关，单糖链皂苷作用显著，某些双糖链皂苷则无溶血作用，但经酶转化成单糖链皂苷后便有了溶血作用。